“肉不坚，腠理疏，则善疾风”，其中指出与发病关系密切的因素是
A. 精神刺激
B. 工作环境
C. 气候因素
D. 体质因素
E. 精神状态

正确答案：D。体质因素

解析：肉不坚，腠理疏，则善病风，意为肌肉不坚实，腠理疏松的人，易患风厥病，明确指出了体质因素决定个体对某种病邪的易感性（D对）。突然、强烈或持续的精神刺激，不仅可以直接伤及脏腑，引起气机紊乱，气血阴阳失调而发病，而且可使正气内虚，抗病能力下降，容易感受病邪而诱发疾病（A错）。精神状态指胸怀开朗乐观，心情舒畅，精神愉快，则人体气机调畅，气血和平，正气旺盛，对于预防疾病发生和发展，促进病情好转，具有重要意义（E错）。工作环境和气候因素与此句话提到的没有关联（BC错）。